以下能够引起急性肾炎的菌种为
A. a溶血性链球菌
B. β溶血性链球菌
C. 肺炎链球菌
D. 草绿色链球菌
E. 金葡菌

正确答案：B。β溶血性链球菌

解析：急性肾小球肾炎是由感染诱发的免疫反应所致的疾病，主要是由β-溶血性链球菌感染所致（B对）。